开放性颅脑损伤特有的临床表现是
A. 颅骨骨折
B. 头皮裂伤
C. 头皮血肿
D. 脑脊液漏
E. 头皮裂伤伴颅骨骨折

正确答案：D。脑脊液漏

解析：开放性颅脑损伤为各种原因所致的头皮、颅骨、硬脑膜和脑组织与外界相通的创伤的统称，其特有的临床表现为脑脊液漏（D对）或脑组织外溢。颅骨骨折（A错）、头皮裂伤（B错）、头皮血肿（C错）、头皮裂伤伴颅骨骨折（E错）既可见于开放性颅脑损伤，也可见于闭合性颅脑损伤。